下列说法符合人类辅助生殖技术伦理要求的是
A. 社会名人负有捐赠其精/卵子的法律义务
B. 医疗机构不得保留供精人工受孕妇女的病历资料
C. 医疗机构不得向未婚大龄妇女提供助孕技术
D. 实施人工授精时，精子库必须保证提供新鲜精液
E. 我国大陆已婚女性，若其丈夫同意可提供无偿代孕服务

正确答案：C。医疗机构不得向未婚大龄妇女提供助孕技术

解析：《人类辅助生殖技术管理办法》第三条规定，医疗机构和医务人员不得实施任何形式的代孕技术（C对E错）。捐赠其精/卵子是自愿的，社会名人没有捐赠其精/卵子的法律义务（A错）。医疗机构可保留供精人工受孕妇女的病历资料（B错），但应保守医密。实施人工授精时，精子库提供的精液是冷冻在零下196.5摄氏度的液氮中长期保存的（D错）。